羌活胜湿汤与九味羌活汤的组成药物中均含有的是
A. 防风、川芎
B. 黄芩、川芎
C. 羌活、藁本
D. 羌活、独活
E. 羌活、蔓荆子

正确答案：A。防风、川芎

解析：该题考查羌活胜湿汤与九味羌活汤的组成。羌活胜湿汤功能祛风，胜湿，止痛，主治风湿在表之痹症，由羌活、独活、藁本、防风、甘草、蔓荆子、川芎组成。九味羌活汤功能发汗祛湿，兼清里热，主治外感风寒湿邪，内有蕴热证，由羌活、防风、苍术、细辛、川芎、香白芷、生地黄、黄芩、甘草组成（A对BCDE错）。记忆：九味羌活防风苍，辛芷芎草芩地黄，发汗祛湿兼清热，分经论治变通良。羌活胜湿独防风，蔓荆藁本草川芎，祛风胜湿通经络，善治周身风湿痛